甘味的作用是
A. 清泄
B. 软坚
C. 渗利
D. 和中
E. 活血

正确答案：D。和中

解析：本题考查五味的所示效用及临床应用。甘味的作用是和中（D对）。甘：能补、能缓、能和，有补虚、和中、缓急、调和药性等作用。如治虚证的黄芪、熟地、核桃仁、枸杞子，治挛急作痛、调和药性的饴糖、甘草等，均具甘味。某些甘味药还能解药、食毒，如甘草、蜂蜜等。此外，甘味药多质润而善于滋燥。苦：能泄、能燥、能坚。其中，能泄的含义有三：一指苦能通泄，如大黄苦寒，功能泻热通便，治热结便秘每用。二指苦能降泄，如苦杏仁味苦降泄肺气，治咳喘气逆必投；代赭石味苦而善降逆，治呃逆呕喘常选。三指苦能清泄（A错），如黄连、栀子味苦，能清热泻火，治火热内蕴或上攻诸证宜择。能燥即指苦能燥湿，如治寒湿的苍术、厚朴，治湿热的黄柏、苦参等，均为苦味。能坚的含义有二：一指苦能坚阴，意即泻火存阴，如黄柏、知母即是；二指坚厚肠胃，如投用少量苦味的黄连，有厚肠止泻的作用等。咸：能软、能下，有软坚（B错）散结、泻下通便作用，如治瘰疬、痰核的昆布、海藻，治癥瘕的鳖甲，治热结便秘的芒硝等，均具咸味。淡：能渗、能利，有渗湿利水（C错）作用，如治水肿、小便不利的猪苓、茯苓，均具淡味。常将淡附于甘。辛：能散、能行，有发散、行气、活血（E错）作用。如治表证的荆芥、薄荷，治气滞的香附，治血瘀的川芎等，都具有辛味。